根据传染途径不同，梅毒可分为
A. 一、二和三期梅毒
B. 梅毒硬下疳、梅毒黏膜斑和梅毒白斑
C. 先天梅毒和后天梅毒
D. 早期梅毒和晚期梅毒
E. 以上都不是

正确答案：C。先天梅毒和后天梅毒

解析：梅毒分胎传梅毒（先天梅毒）和获得性梅毒。后者分为3期，即一期梅毒、二期梅毒及晚期梅毒。病史在2年的第一与第二期合称早期梅毒；超过2年时称晚期梅毒。掌握“梅毒的口腔表征”知识点。